抗体与抗原结合的部位是
A. VL和VH区
B. CH1区
C. 铰链区
D. CH3区
E. CD4区

正确答案：A。VL和VH区